治疗心悸，应首选
A. 合谷
B. 尺泽
C. 内关
D. 太冲
E. 劳宫

正确答案：C。内关

解析：心悸以调理心气、安神定悸为法，主穴为内关、郄门、神门、厥阴俞、膻中。内关（C对）为心经络穴，八脉交会穴（通于阴维脉），主治心痛、胸闷、心动过速或过缓等心系病证，胃腑病证，偏瘫、中风、眩晕、偏头痛，神志疾病，肘臂挛痛等病症。太冲穴（D错）主治头痛、眩晕、目赤肿痛、胁痛、遗尿、疝气、崩漏、月经不调、癫痫、呕逆、小儿惊风、下肢痿痹等。劳宫（E错）是心包经腧穴，但主要功能是开窍泄热，清心安神和调阴阳。合谷（A错）主治头痛、目赤肿痛、齿痛、鼻衄、口眼歪斜、耳聋等头面五官诸疾；发热恶寒等外感病证；热病无汗或多汗；经闭、滞产等妇产科病证；牙拔除术、甲状腺手术等口面五官及颈部手术针麻常用穴。尺泽（B错）主治咳嗽、气喘、咯血、咽喉肿痛等肺系实热性病证；急性吐泻、中暑、小儿惊风等急症。